某女，55岁，头痛眩晕一周，兼见目赤耳鸣，口燥咽干，大便燥结，证属胃肠积热，宜选用的成药是
A. 黛蛤散
B. 新雪颗粒
C. 牛黄至宝丸
D. 防风通圣丸
E. 清胃黄连片

正确答案：C。牛黄至宝丸

解析：本题考查的是牛黄至宝丸的主治。头痛眩晕一周，兼见目赤耳鸣，口燥咽干，大便燥结，证属胃肠积热，宜选用的成药是牛黄至宝丸（C对）。牛黄至宝丸：【主治】胃肠积热所致的头痛眩晕、目赤耳鸣、口燥咽干、大便燥结。黛蛤散（A错）：【主治】肝火犯肺所致的头晕耳鸣、咳嗽吐衄、痰多黄稠、咽膈不利、口渴心烦。新雪颗粒（B错）：【主治】外感热病，热毒壅盛证，症见高热、烦躁；扁桃体炎、上呼吸道感染、气管炎、感冒见上述证候者。防风通圣丸（D错）：【主治】外寒内热，表里俱实，恶寒壮热，头痛咽干，小便短赤，大便秘结，瘰疬初起，风疹湿疮。清胃黄连片（E错）：【主治】肺胃火盛所致的口舌生疮，齿龈、咽喉肿痛。